临床上进行腰穿是将针头刺入
A. 硬膜下隙
B. 硬膜外隙
C. 马尾
D. 蛛网膜下隙
E. 以上都不对

正确答案：D。蛛网膜下隙

解析：蛛网膜下隙有许多结缔组织小梁相连，间隙内充满脑脊液，临床上进行腰穿是将针头刺入蛛网膜下隙（D对）。